中度四环素着色临床表现
A. 牙着色的颜色由棕黄色到黑灰色
B. 整个牙面呈现黄色和灰色，分布均匀
C. 牙表面着色深，严重者呈灰棕色、蓝紫色
D. 牙表面有明显的带状着色，颜色呈黄灰色或黑色
E. 牙釉质表面上可有少量的浅沟、小凹点或细横纹

正确答案：A。牙着色的颜色由棕黄色到黑灰色

解析：中度四环素着色：牙着色的颜色由棕黄色到黑灰色。掌握“四环素牙齿”知识点。